关于子宫下段说法，正确的是
A. 为临产后的子宫颈
B. 孕16周扩展成宫腔的一部分
C. 临产后的子宫颈伸展可达7～10cm
D. 由非孕时的子宫峡部伸展形成
E. 孕中期的子宫颈扩展为宫腔的一部分

正确答案：D。由非孕时的子宫峡部伸展形成

解析：子宫下段为非孕时的子宫峡部（D对AE错）在妊娠12周（B错）后逐渐伸展变长，扩展为宫腔的一部分。子宫峡部临产后伸展至7～10cm（C错），成为产道的一部分，是产科手术学的重要解剖结构。